外周气道阻塞时，呼吸困难主要表现为:
A. 吸气性呼吸困难
B. 呼气性呼吸困难
C. 呼吸加深加快
D. 阵发性呼吸困难
E. 以上都不对

正确答案：B。呼气性呼吸困难

解析：外周气道阻塞时，呼吸困难主要表现为呼气性呼吸困难（B对）。